患者女性，60岁舌左侧缘中部溃烂5个月，约2.3cm×1.5cm×0.5cm大小，活检报告为“鳞癌”，左下6残根，边缘锐利。关于舌癌下列哪种说法是错误的
A. 舌癌是最常见的口腔癌
B. 男性多于女性
C. 近年来女性增多及年龄更年轻化
D. 常为外生型
E. 晚期可蔓延至口底或下颌骨

正确答案：D。常为外生型

解析：本题考查舌癌的临床表现。患者女性，60岁舌左侧缘中部溃烂5个月，约2.3cm×1.5cm×0.5cm大小，活检报告为“鳞癌”，左下6残根，边缘锐利，考虑为舌癌，关于舌癌说法错误的是常为外生型（D错，为本题正确答案）。舌癌多发生于舌缘，其次为舌尖、舌背。常为溃疡型或浸润型。舌癌是最常见的口腔癌（A对），男性多于女性（B对），但是近年来有女性增多及发病率更年轻化的趋势（C对），舌癌多发生于舌缘，其次为舌尖、舌背，一般恶性程度较高，生长快，浸润性较强，常波及舌肌，致舌运动受限。有时说话、进食及吞咽内发生困难。晚期舌癌可蔓延至口底肌肉及下颌骨（E对），使全舌固定；向后发展可以侵犯腭舌弓及扁桃体。如有继发感染或侵犯舌根常发生剧烈疼痛，疼痛可反射至耳颞部及整个同侧的头面部。